血中哪种激素出现高峰可作为排卵的标志
A. 催乳素
B. 卵泡刺激素
C. 黄体生成素
D. 催乳素释放因子
E. 催乳素释放抑制因子

正确答案：C。黄体生成素